老年人长期泡服胖大海易致的不良反应有
A. 消瘦
B. 饮食减少
C. 大便溏泻
D. 尿赤涩痛
E. 脘腹痞闷

正确答案：A、B、C、E。消瘦；饮食减少；大便溏泻；脘腹痞闷

解析：本题考查的是选择合适的用药剂量。老年人长期泡服胖大海易致的不良反应有消瘦（A对）、饮食减少（B对）、大便溏泻（C对）与脘腹痞闷（E对）。胖大海作为保健饮料长期泡服，易致大便溏泻、饮食减少、脘腹痞闷、消瘦。尿赤涩痛（D错）不属于长期泡服胖大海的不良反应。